属非氟喹诺酮类的药物是
A. 培氟沙星
B. 诺氟沙星
C. 环丙沙星
D. 伊诺沙星
E. 吡哌酸

正确答案：E。吡哌酸

解析：本题考查喹诺酮类药物。吡哌酸（E错，为本题正确答案）属于非氟喹诺酮类药物。培氟沙星（A对）、诺氟沙星（B对）、环丙沙星（C对）、伊诺沙星（D对）属于氟喹诺酮类抗菌药物，为第三代喹诺酮类药物。